患者，男，40岁。胃脘胀满而痛，不思饮食，四肢倦怠，舌苔白腻，脉弦滑。治疗应首选
A. 厚朴温中汤
B. 平胃散
C. 半夏泻心汤
D. 旋复代赭汤
E. 二陈汤

正确答案：A。厚朴温中汤

解析：患者胃脘胀满而痛，不思饮食，四肢倦怠，舌苔白腻，脉弦滑。因脾胃伤于寒湿所致。方用厚朴温中汤，为治疗脾胃寒湿气滞的常用方。厚朴行气消账，燥湿除満；草豆蔻温中散寒，燥湿运脾；陈皮、木香行气宽中，干姜、生姜温脾暖胃；茯苓渗湿健脾；甘草调和诸药（A对）。平胃散为治疗湿滞脾胃的基础方（B错）。（P87）“半夏泻心汤为治疗中气虚弱，寒热错杂，升降失常而致肠胃不和的常用方，又是体现平调寒热、苦降辛开治法的代表方”（C错）。旋覆代赭汤为治疗胃虚痰阻气逆证的常用方（D错）。二陈汤主治之咳嗽属于湿痰证。为燥湿化痰的基础方（E错）。